关于流产的定义，下列哪项是正确的
A. 妊娠＜28周，胎儿体重＜1000g
B. 妊娠＜20周，胎儿体重＜500g
C. 妊娠20～27周，胎儿体重＜500g
D. 妊娠20～27周，胎儿体重＜1000g
E. 妊娠12～20周，胎儿体重＜500g

正确答案：A。妊娠＜28周，胎儿体重＜1000g